硫酸庆大霉素中庆大霉素C组分检查应采用的方法是
A. 红外分光光度法
B. 紫外-可见分光光度法
C. 分子排阻色谱法
D. 高效液相色谱法
E. 抗生素微生物检定法

正确答案：D。高效液相色谱法

解析：本题考查抗生素类药物的有关物质及组分与检查。中国药典采用高效液相色谱法（D对）测定庆大霉素C各组分的含量。抗生素微生物检定法（E错）用于硫酸庆大霉素注射液含量测定。